在脊髓胸5节(T5)以下不含有
A. 薄束
B. 楔束
C. 皮质脊髓侧束
D. 脊髓丘脑侧束
E. 脊髓丘脑前束

正确答案：B。楔束

解析：楔束起自同侧第 4 胸节及以上的脊神经节细胞，因此在脊髓胸5节(T5)以下不含有楔束（B对）；薄束（A错）在第 5 胸节以下占据后索的全部；皮质脊髓侧束（C错）在脊髓外侧索后部下行，直至骶髓（约 S4) 纤维依次经各节段灰质中继后或直接终于同侧前角运动神经元；脊髓丘脑束主要起自脊髓灰质I和IV层，纤维经白质前连合交叉至对侧时上升 1～2 节段（即边交叉边上升），或先上升1～2节段后再经白质前连合，交叉至对侧外侧索和前索上行，止于背侧丘脑，因此在脊髓胸5节(T5)以下含有脊髓丘脑侧束（D错）和脊髓丘脑前束（E错）。